红外吸收光谱压片有哪些
A. 乙醇
B. 乙醚
C. 苯
D. 氯化钾
E. 溴化钾

正确答案：D、E。氯化钾；溴化钾

解析：本题考查原料药的结构确证。红外吸收光谱通过对药物进行红外吸收光谱测试，可推测出药物中可能存在的化学键、所含的官能团及其初步的连接方式，亦可给出药物的构型、晶型、立体构象等信息。固态药物红外测试可分为压片法、糊法、薄膜法，液态药物可采用液膜法测试，气态药物则可采用气体池测定。红外吸收光谱法常用盐片有氯化钾（D对）（KCl）、溴化钾（E对）（KBr）和氯化钠（NaCl）等,它们均易被水气溶蚀。因此，应注意保持干燥，且不能用于对盐片有溶解性样品的测定。